氢氯噻嗪具有下列哪种作用
A. 有利尿作用
B. 有降压作用
C. 两者皆有
D. 两者皆无

正确答案：C。两者皆有

解析：本题考查氢氯噻嗪。氢氯噻嗪有利尿和降压作用（C对）。噻嗪类是临床广泛应用的一类口服利尿剂和抗高血压药。氢氯噻嗪是本类药的原形药物。氢氯噻嗪作用于髓袢升支厚壁段皮质部和远曲小管初段，其作用机制是直接抑制远曲小管初段腔壁上的Na⁺-Cl⁻共转运子的功能，由此减少了肾小管对Na⁺、Cl⁻和水的重吸收，为中效利尿剂。氢氯噻嗪常与ACEI、ARB、CCB和周围血管扩张剂组成复方制剂，用于高血压的治疗。一方面氢氯噻嗪通过减少水钠潴留、松弛外周血管、抑制肾素-血管紧张素-醛固酮系统（RAAS）等多重机制增强降压效果；另一方面RAAS抑制剂还可减少噻嗪类利尿剂所致的RAAS激活和低血钾等不良反应。尤适用于充血性心力衰竭、老年高血压，单纯收缩期高血压。